非竞争性拮抗剂的特点是
A. 亲和力及内在活性都强
B. 具有一定亲和力但内在活性弱
C. 与亲和力和内在活性无关
D. 有亲和力、无内在活性，与受体不可逆性结合
E. 有亲和力、无内在活性，与激动剂竞争相同受体

正确答案：D。有亲和力、无内在活性，与受体不可逆性结合

解析：本题考查作用于受体药物的分类。非竞争性拮抗剂的特点是有亲和力、无内在活性，与受体不可逆性结合（D对）。非竞争性拮抗剂对受体亲和力较强、结合牢固，但缺乏内在活性（α=0）。非竞争性拮抗剂通过共价键作用于受体结合牢固，呈不可逆性，妨碍激动剂与特异性受体结合。亲和力及内在活性都强（A错）的是完全激动药。具有一定亲和力但内在活性弱（B错）的是部分激动药。与亲和力和内在活性无关（C错）的是非特异性药物。有亲和力、无内在活性，与激动剂竞争相同受体（D错）的是竞争性拮抗剂。